患者，男，40岁。发现血压高半年，最高达150/100mmHg，伴乏力，肌痛，口渴。吸烟20年。查体：血压170/100mmHg，肥胖，心脏不大，心律整齐，心率：76次/分，双下肢不肿。尿常规：尿蛋白（+），比重1.018，血钾3.1mmol/L。最可能的诊断是
A. 原发性醛固酮增多症
B. 原发性高血压
C. 肾性高血压
D. 肾血管性髙血压
E. 嗜铬细胞瘤

正确答案：A。原发性醛固酮增多症

解析：中年男性患者，出现血压升高，乏力、肌痛（低钾血症引起），低钾血症（＜3.5mmol/L），尿比重低，尿蛋白阳性（慢性失钾导致肾小管上皮细胞损伤变性、尿浓缩功能减低），最可能的诊断为原发性醛固酮增多症（A对）。原发性醛固酮增多症患者由于血醛固酮增多可导致水钠潴留引起高血压，由于尿中排钾增加可导致低钾血症，因此原发性醛固酮增多症以高血压与低钾血症为主要特征。原发性高血压（B错）不会出现明显的低血钾及其引起的神经肌肉症状。肾性高血压（C错）为肾脏疾病引起的继发性高血压，往往在发现血压升高时已有蛋白尿、血尿和贫血、肾小球滤过功能下降（P259），一般无低血钾、肌无力等表现。肾血管性高血压（D错）是单侧或双侧肾动脉主干或分支狭窄引起的高血压，进展迅速且不会出现低血钾和乏力。嗜铬细胞瘤（E错）以阵发性高血压、儿茶酚胺增多为特征性表现，可发生低血压、休克，低血钾少见。